早期诊断急性血源性骨髓炎最有价值的方法是
A. X线照片
B. CT
C. 核素骨扫描
D. 局部分层穿刺
E. 血培养

正确答案：D。局部分层穿刺

解析：早期诊断急性骨髓炎最有价值的方法是局部分层穿刺（D对），穿刺抽出混浊液体或血性液可作涂片检查与细菌培养，涂片中发现多是脓细胞或细菌即可明确诊断。X线（A错）在起病后2周才可发现异常，对急性骨髓炎的早期诊断价值不大。CT（B错）可提前发现骨膜下脓肿，但对小的骨脓肿仍难以显示。核素骨扫描（C错）只能显示出病变的部位，不能做出定性诊断，只具有早期间接帮助诊断的价值。血培养（E错）可以获得致病菌，但阳性率较低且所需时间较长，对早期诊断价值不大。